代谢性酸中毒对机体的影响表现为
A. 室性心律失常
B. 心肌收缩力降低
C. 血管对儿茶酚胺的反应性下降
D. 意识障碍
E. 以上都是

正确答案：E。以上都是

解析：机体发生代谢性酸中毒时由于血钾浓度上升，导致严重的传导阻滞，发生室性心律失常（A对）。H+浓度上升影响心肌细胞内Ca2+的浓度，导致心肌收缩力降低（B对）。H+增多时，也可使心肌和外周血管对儿茶酚胺的反应性下降（C对），使血管扩张，血压下降。酸中毒时生物氧化酶类的活性受到抑制，ATP生成减少，同时脑组织内谷氨酸脱羧酶活性增强，使y-氨基丁酸增多，后者对中枢神经系统具有抑制作用，导致中枢神经系统的代谢障碍，可表现为意识障碍（D对，故E为本题正确答案）。